患者，男，47岁，肾移植术后抗排异治疗，不应选用的药物是
A. 环孢素
B. 他克莫司
C. 吗替麦考酚酯
D. 伏立康唑
E. 糖皮质激素

正确答案：D。伏立康唑

解析：本题考查常用免疫抑制剂。肾移植术后抗排异治疗，不应选用的药物是伏立康唑（D错，为本题正确答案）。肾移植术后抗排异治疗，应用免疫抑制剂。伏立康唑为常用的抗菌药。目前临床上常用的免疫抑制剂主要有糖皮质激素类（E对）、钙调磷酸酶抑制剂（CNI，如他克莫司（B对）、环孢素（A对））、雷帕霉素靶蛋白抑制剂（mTOR，如西罗莫司）、嘌呤和嘧啶合成抑制剂（如吗替麦考酚酯（C对）、咪唑立宾、硫唑嘌呤）等。